男，35岁。1小时前车祸外伤出血，出血量约为1000ml。查体：BP100/70mmHg，体重70kg，面色苍白，心率120次/分。该患者受伤后机体首先发生的反应是
A. 外周血管阻力降低
B. 循环血液中儿茶酚胺减少
C. 外周血管阻力不变
D. 脑和心脏的血管收缩
E. 外周血管阻力增加

正确答案：E。外周血管阻力增加

解析：患者中年男性，1小时前车祸外伤出血，出血量约为1000ml。查体：BP100/70mmHg（正常血压90～120/60～80mmHg），面色苍白（休克常见表现），心率120次/分（正常60～100次/分）。可诊断为休克。患者休克后早期由于有效外周血容量减少，引起循环血量降低，动脉血压下降，反射性引起交感-肾上腺轴兴奋导致大量儿茶酚胺释放（B错）以及肾素-血管紧张素分泌增加，引起心跳加快、心排出量增加和外周皮肤、内脏的小血管收缩（E对AC错）使循环血量重新分配，以保持心、脑的血液灌注量（D错）。